男，22岁。体检心电图提示“左室肥厚、V₁-V₆巨大倒置T波”来诊。平素无不适。查体：BP110/70mmllg，心率97次/分，律齐，胸骨左缘第3-4肋间可闻及收缩期杂音，伴震颤。该患者治疗不宜选择
A. 地高辛
B. 比索洛尔
C. 美托洛尔
D. 地尔硫䓬
E. 阿西洛尔

正确答案：A。地高辛

解析：22岁青年男性患者，心电图提示“左室肥厚、V₁-V₆巨大倒置T波”（提示左心室代偿结构改变，心肌缺血）来诊，胸骨左缘第3-4肋间可闻及收缩期杂音（提示左心室流出道狭窄），综合该患者年龄特征、心电图表现、体格检查考虑诊断肥厚型心肌病。肥厚型心肌病一线药物治疗是β受体拮抗剂（BCE对），可减慢心率并降低心肌收缩力，使舒张期充盈时间延长，室壁张力降低，改善胸痛及劳力性呼吸困难，并具有抗心律失常作用。非二氢吡啶类钙通道阻滞剂（D对）也具有负性变时和减弱心肌收缩力作用，可改善心室舒张功能，对减轻左心室流出道梗阻也有一定治疗效果，可用于那些不能耐受β受体拮抗剂的病人。使用洋地黄类药物（A错，为本题正确答案）可导致心肌收缩力增强，左室流出道两端压力差增大，血流速度加快，从而使二尖瓣前叶收缩期更加明显，加重流出道梗阻，最终使肥厚型梗阻性心肌病患者心输出量进一步减少，加剧临床症状。